苯环上的一个氢被烷基取代，其毒性发生改变
A. 苯对造血功能主要是抑制作用，而甲苯为麻醉作用
B. 苯主要从呼吸道，对呼吸道系统有毒性作用，而甲苯没有
C. 苯中毒产生过量的儿茶酚胺刺激心肌细胞发生心室颤动，而甲苯没有
D. 苯为致癌物，甲苯为工业毒物

正确答案：A。苯对造血功能主要是抑制作用，而甲苯为麻醉作用

解析：本题考查取代基团对毒性的影响。苯环上的一个氢被烷基取代，其毒性发生改变为：苯对造血功能主要是抑制作用，而甲苯为麻醉作用（A对BCD错）。